患者汗出恶风，微劳尤甚，易于感冒，体倦乏力，面色少华，舌苔薄白，脉细弱。治疗应首选
A. 黄芪汤
B. 补肺汤
C. 玉屏风散
D. 桂枝汤
E. 补中益气汤

正确答案：C。玉屏风散

解析：患者以汗出恶风，微劳尤甚为主诉，故诊断为自汗。患者肺气亏虚，肌表疏松，表卫不固而汗出恶风，且易于感冒；动则耗气，气不摄汗，故汗出益甚；气虚则体倦乏力，面色少华。结合舌脉分析，本病属于肺卫不固之汗证，故采用益气固表的玉屏风散（C对）。黄芪汤功能益气托脓，泻火解毒。主治肺脓疡气虚性便秘，大便并不硬，虽有便意，但排便困难，便后乏力，面白神疲，脉弱（A错）。补肺汤用于肺气不足，养阴润肺，化痰止咳（B错）。桂枝汤为解表剂，具有辛温解表，解肌发表，调和营卫之功效。主治头痛发热，汗出恶风，鼻鸣干呕，苔白不渴，脉浮缓或浮弱者，用于太阳中风表虚证（D错）。补中益气汤用于脾虚气陷证，气虚发热证（E错）。